感染形成脓肿时面部肿胀明显但不易发现波动感的间隙为
A. 眶下间隙
B. 翼下颌间隙
C. 咬肌间隙
D. 下颌下间隙
E. 颞间隙感染

正确答案：C。咬肌间隙

解析：本题考查咬肌间隙感染。咬肌间隙感染（C对）形成脓肿时，面部肿胀明显，但不易发现波动感。眶下间隙（A错）位于眼眶前部的下方，脓肿形成后，眶下区可触及波动感。翼下颌间隙感染（B错）位置深在，脓肿形成后，面部肿胀不明显，仅下颌支后缘稍内侧轻度肿胀，临床难以直接触及波动感，穿刺方可确定。下颌下间隙感染（D错），下颌下三角区肿胀，呈凹陷性水肿，脓肿形成后，可触及明显波动感。颞间隙感染（E错），脓肿形成后，颞浅间隙脓肿可触及波动感，颞深间隙脓肿则需穿刺抽脓确诊。